粉末生化，升华物白色柱形，菱形结晶的是
A. 斑蝥
B. 水蛭
C. 全蜗
D. 蜈蚣
E. 地龙

正确答案：A。斑蝥

解析：本题考查的是斑蝥的理化鉴别。粉末生化，升华物白色柱形，菱形结晶的是斑蝥（A对）。斑蝥的升华物（在30℃～140℃）为白色柱状或小片状结晶（斑蝥素），加碱液溶解，再加酸又析出结晶。